患者年龄是21岁，PD4-6，经常出血，牙龈肿胀，龈缘有红边，经过牙周治疗一年来未见好转，检查
A. HIV
B. 血象
C. 疱疹病毒
D. 温度

正确答案：A。HIV

解析：本题考查为与HIV有关的牙周病损。据题干的临床表现可诊断为线形牙龈红斑(LGE)，在龈缘处有明显的鲜红的宽约2-3mm的红边，在附着龈上可呈淤斑状，极易出血。LGE为与HIV有关的牙周病损，因此要检查HIV（A对）。